仅在活的易感细胞中才能复制的是
A. 螺旋体
B. 支原体
C. 衣原体
D. 立克次体
E. 病毒

正确答案：E。病毒

解析：非细胞型微生物：非细胞型微生物为形体最小，以纳米（nm）为测量单位，结构最为简单，仅含有一种核酸RNA或DNA，或仅为传染性蛋白粒子，具有超级寄生性，仅在活的易感细胞中才能复制，且易变异的最低等生物体，包括病毒、朊粒等。掌握“微生物定义、分类及特点”知识点。